紫外线对饮用水进行消毒时，水深最好不要超过
A. 8cm
B. 10cm
C. 12cm
D. 14cm
E. 16cm

正确答案：C。12cm

解析：本题考查紫外线消毒的相关内容。紫外线对饮用水进行消毒时，水深最好不要超过12cm（C对ABDE错）。紫外线消毒的优点是接触时间短、杀菌效率高，对致病微生物有广谱消毒效果；对隐孢子虫有特殊消毒效果；不产生有毒有害物质；能降低臭和味，并降解微量有机污染物；消毒效果受水温和pH影响不大。缺点是没有持续消毒效果，需与氯配合使用，且价格较贵。